正确描述侧脑室的是
A. 位于两侧间脑之间
B. 仅有一个
C. 内无脉络丛
D. 分中央部、前角、后角和下角
E. 直接通中脑水管

正确答案：D。分中央部、前角、后角和下角

解析：侧脑室为位于大脑半球内（A错）的腔道，左右各一（B错），分为中央部、前角、后角、下角（D对）四部分：中央部位于顶叶内，室间孔和胼胝体压部之间；前角伸向额叶，室间孔以前的部分；后角伸入枕叶，下角最长伸到颞叶内。侧脑室内有脉络丛（C错）和脑脊液，脑脊液可通过左右室间孔与第三脑室相通（E错）。中脑水管连通的是第三脑室与第四脑室。